发病率的分子是一定期间内某暴露人口中某病的
A. 新发病例数
B. 现患某病的新旧病例数
C. 已感染者人数
D. 已患病例人数
E. 治愈者人数

正确答案：A。新发病例数